最支持肝硬化腹水诊断的是
A. 腹水比重＜1.018，蛋白＜25g/L
B. 腹水白细胞数＞500×10⁶/L，以多核细胞为主
C. 腹水比重＞1.018，蛋白＞30g/L，腹水白细胞以单核细胞为主
D. 血性腹水
E. 乳糜性腹水

正确答案：A。腹水比重＜1.018，蛋白＜25g/L

解析：肝硬化时，白蛋白合成减少，导致血浆胶体渗透压降低，产生的腹水为漏出液。漏出液比重小于1.018，蛋白小于25g/L（A对C错），白细胞小于500×10⁶/L（B错）。血性腹水（D错）见于创伤、外科手术、肿瘤、结核感染等。乳糜性腹水（E错）是由于胸导管破坏、受压或浸润造成的，见于肿瘤、结核和外伤等疾病。